他汀类药物可用于
A. 动脉粥样硬化
B. 静脉血栓形成
C. 肾病综合征
D. 血管成形术后再狭窄
E. 器官移植后排异反应

正确答案：A、C、D、E。动脉粥样硬化；肾病综合征；血管成形术后再狭窄；器官移植后排异反应

解析：本题考查他汀类药物。他汀类药物的临床应用：1.调血脂。2.肾病综合征（C对）。3.血管成形术后再狭窄（D对）。4.预防心脑血管急性事件：他汀类能通过增加动脉粥样硬化斑块的稳定性或使斑块缩小而减少脑卒中或心肌梗死的发生（A对）。5.缓解器官移植后的排斥反应（E对）和治疗骨质疏松。静脉血栓（B错）主要是由于各种原因导致静脉回流压力降低或血液黏度增加、血液凝固性增加，常用肝素、双香豆素等药物进行预防和治疗。